艾滋病健康教育的行为干预目标是
A. 降低高危性行为
B. 提高对STD的规则治疗需求
C. 对HIV感染和STD预防的规范寻求政策支持
D. 减少对AIDS患者和HIV感染者的冷漠和歧视
E. 以上各项都正确

正确答案：E。以上各项都正确